下列哪项不是表示疾病流行强度的指标
A. 暴发
B. 大流行
C. 短期波动
D. 散发
E. 流行

正确答案：C。短期波动

解析：暴发（A对）、大流行（B对）、散发（D对）、流行（E对）均为表示疾病流行强度的指标。 短期波动为疾病的时间分布特征的一种类型，不是表示疾病流行强度的指标，其含义与疾病流行强度指标中的暴发相似，区别在于暴发常用于较局限的区域和较小的人群，而短期波动常用于较大区域和较大的人群（C错，为本题正确答案）。